治疗肝癌气滞血瘀证，应首选
A. 疏肝理气，活血化瘀
B. 清热利湿，解毒破结
C. 养阴清热，解毒祛瘀
D. 理气化痰，消食散结
E. 温中散寒，健脾调胃

正确答案：A。疏肝理气，活血化瘀

解析：肝癌气滞血瘀，结为癥块，不通则痛，治宜疏肝理气，活血化瘀，方选逍遥散合桃红四物汤（A对）。清热利湿，解毒破结为治疗肝癌湿热瘀毒证的治法（B错）。养阴清热，解毒祛瘀为肝癌肝肾阴虚证的治法（C错）。理气化痰，消食散结为胃癌痰气交阻证的治法（D错）。温中散寒，健脾调胃为胃癌脾胃虚寒证的治法（E错）。